最能显著反映甲状腺功能状态的指标是
A. 血浆总T₃、₄浓度
B. 血浆结合型T₃、T₄浓度
C. 血浆T₃浓度
D. 血浆游离甲状腺素浓度
E. 血浆甲状腺素结合能力

正确答案：D。血浆游离甲状腺素浓度

解析：血浆游离甲状腺素浓度（D对）不受血浆TBG的影响，直接测定血浆游离甲状腺素浓度对了解甲状腺功能状态比T₄更有意义，是反映甲状腺激素活性的更好指标。血浆总T₃、4浓度（A错）、血浆结合型T₃、T₄浓度（B错）、血浆T₃浓度（C错）都受甲状腺球蛋白的影响。血浆甲状腺素结合能力（E错），在临床很少测定此能力。